常伴有AFP升高的卵巢肿瘤是
A. 颗粒细胞瘤
B. 成熟型畸胎瘤
C. 上皮性肿瘤
D. 卵黄囊瘤
E. 无性细胞瘤

正确答案：D。卵黄囊瘤

解析：AFP是在胎儿早期由肝脏和卵黄囊合成的一种血清糖蛋白，出生后，AFP的合成很快受到抑制。卵黄囊瘤又名内胚窦瘤，肿瘤来源于胚外结构卵黄囊，为卵巢恶性肿瘤，产生甲胎蛋白（AFP），故血清AFP的升高，是诊断及病情监测的重要标志物（D对）。